现况调查的结果常用下列哪种指标
A. 发病率
B. 死亡率
C. 患病率
D. 病死率
E. 罹患率

正确答案：C。患病率

解析：本题考查现况调查的指标。现况调查所得到的频率指标一般为特定时间内调查群体的患病率（C对ABDE错），因此患病率是现况调查常用的指标。